胎儿的面部初步完成是在胚胎发育
A. 第4周
B. 第6周
C. 第8周
D. 第10周
E. 第12周

正确答案：C。第8周

解析：胚胎发育至第8周时，胎儿的面部初步完成。掌握“唇腭裂概述”知识点。